根据《处方管理办法》，属于处方前记内容的是
A. 药品生产企业名称
B. 医师签名、药品金额
C. 患者姓名、临床诊断
D. 药品名称、剂型、规格、数量、用法用量

正确答案：C。患者姓名、临床诊断

解析：本题考查的是处方内容。根据《处方管理办法》，属于处方前记内容的是患者姓名、临床诊断（C对）。处方前记包括医疗机构名称、患者姓名、性别、年龄、门诊或住院病历号，科别或病区和床位号、临床诊断、开具日期等，可添列特殊要求的项目。麻醉药品和第一类精神药品处方还应当包括患者身份证明编号，代办人姓名、身份证明编号。正文分列药品名称、剂型、规格、数量、用法用量（D错）。后记包括医师签名或者加盖专用签章，药品金额以及审核、调配，核对、发药药师签名或者加盖专用签章（B错）。